患者，男，外伤导致21牙冠切2/3缺损，在其修复初诊时不必问诊的内容是
A. 目前的自觉症状
B. 要求解决的主要问题
C. 以前的治疗情况
D. 曾经接受过的检查
E. 发生外伤时是否意识清楚

正确答案：E。发生外伤时是否意识清楚

解析：对于牙体缺损的修复治疗，在初诊时对于发生意外时是否已是清楚是不必过问的，与初诊以及随后的修复治疗意义不大。掌握“修复学病史采集”知识点。